毛果芸香碱的主要适应证是
A. 青光眼
B. 角膜炎
C. 结膜炎
D. 视神经水肿
E. 晶状体混浊

正确答案：A。青光眼

解析：青光眼（A对）可分为闭角型和开角型两种，前者为急性或慢性充血性青光眼，表现为前房角狭窄，房水回流受阻而使眼内压升高，毛果芸香碱能使前房角间隙扩大，房水回流通畅，眼内压迅速降低，因而可用于治疗闭角型青光眼；开角型为慢性单纯性青光眼，主要因小梁网本身以及巩膜静脉窦发生变性或硬化，阻碍了房水循环，引起眼内压升高，毛果芸香碱能扩张巩膜静脉窦周围的小血管以及收缩睫状肌，使小梁网结构发生改变而使眼内压下降，故也可用于开角型青光眼。角膜炎（B错）是指因角膜外伤，细菌及病毒侵入角膜引起的炎症，分溃疡性角膜炎（又名角膜溃疡）、非溃疡性角膜炎（即深层角膜炎）两类，临床常用氯霉素以及地塞米松等滴眼液进行治疗。结膜炎（C错）是发生在眼结膜的炎症性反应，常用氧氟沙星滴眼液等抗感染药物进行治疗。视神经水肿（D错）多由其他原因如颅内压升高等引起的，常用大剂量皮质固醇类药物如地塞米松进行治疗。晶状体混浊（E错）由于悬韧带全部或部分断裂所致，可采用手术进行治疗。